男，15岁，1个月前因学习退步被班主任批评后，渐起入睡困难，早醒，伴有情绪低落，自觉能力差，对前途悲观绝望，怀疑同学看不起他，嘲笑他，常自责，觉得对不起父母的培养，称活得太累，计划趁家人不备自杀。有时焦躁不安，用拳头砸墙发泄情绪。目前首选的治疗方法是
A. 心境稳定剂合并抗精神病药
B. 电抽搐合并抗焦虑药
C. 电抽搐合并抗精神病药
D. 心境稳定剂合并电抽搐
E. 电抽搐合并抗抑郁药

正确答案：E。电抽搐合并抗抑郁药

解析：患者男性青少年，情绪低落，意志活动减退，思维迟缓，负性认知模式（抑郁发作典型症状）；自责自罪，有自杀观念和行为，间或感到焦虑（精神病性症状）；有睡眠障碍，精力下降，砸拳发泄（躯体症状群），最可能的诊断是抑郁发作。患者有自杀观念和行为，因此首选电抽搐治疗（MECT），MECT可有效地缓解重性抑郁障碍患者的症状，对伴有自杀观念的患者有较好的疗效，可在较短时间内快速地控制自杀意念，从而降低患者自杀死亡率，并建议与抗抑郁药联合治疗，避免治疗停止后症状复发（E对）（P118）。